在艾滋病治疗与救助工作中，医疗卫生机构职责不包括
A. 进行预防艾滋病母婴传播技术指导
B. 防止发生艾滋病医院感染
C. 提供艾滋病防治咨询服务
D. 将感染或发病事实告知其近亲属
E. 提供艾滋病诊断和治疗服务

正确答案：D。将感染或发病事实告知其近亲属

解析：在艾滋病治疗与救助工作中，医疗卫生机构职责包括：进行预防艾滋病母婴传播技术指导（A对），防止发生艾滋病医院感染（B对），提供艾滋病防治咨询服务（C对），将感染或发病事实告知本人（D错，为本题正确答案），提供艾滋病诊断和治疗服务（E对）。